男，62岁。上腹痛2周。既往高血压病史10余年，反复心前区疼痛发作2个月，口服阿司匹林100mg/日。上消化道X线钡剂造影：胃角切迹壁外龛影，¹³C尿素呼气试验阳性。最适宜的治疗药物是
A. 雷尼替丁
B. 多潘立酮
C. 枸橼酸铋钾
D. 奥美拉唑
E. 氢氧化铝

正确答案：D。奥美拉唑

解析：老年男性患者，既往有服用NSAIDs病史（长期服用NSAIDs可导致消化性溃疡），上腹痛两周，上消化道X线钡剂造影：胃角切迹壁外龛影（胃角切迹溃疡）。实验室检查：¹³C尿素呼气试验阳性提示Hp（幽门螺杆菌）感染。综合患者病史、X线钡剂造影及实验室检查，该患者诊断考虑为胃溃疡。奥美拉唑（PPI）（D对）抑酸作用最强，疗效最好，是消化性溃疡的首选药物。雷尼替丁（A错）是H₂受体拮抗剂，多潘立酮（B错）是促胃肠动力药，枸橼酸铋钾（C错）是胃黏膜保护剂，氢氧化铝（E错）是弱碱性抗酸剂，以上四种药物治疗消化性溃疡效果均不及奥美拉唑。